抑酸剂泮托拉唑长期应用可引起的典型不良反应是
A. 血糖升高
B. 血尿酸升高
C. 低镁血症
D. 定向力障碍
E. 胀气

正确答案：C。低镁血症

解析：本题考查泮托拉唑。抑酸剂泮托拉唑长期应用可引起的典型不良反应是低镁血症（C对）。碳酸氢钠、碳酸钙因释放二氧化碳，可出现呃逆、腹胀和嗳气（E错），引起反跳性胃酸分泌增加；西咪替丁不良反应是幻觉、定向力障碍（D错）。